依据《中华人民共和国药品管理法》的规定，药品经营企业无须从具有药品生产、经营资格的企业购进的药品时
A. 未实施批准文号管理的中药材
B. 医院制剂
C. 预防性生物制品
D. 新发现和从国外引种的药材
E. 中药饮片

正确答案：A。未实施批准文号管理的中药材

解析：本题考查中华人民共和国药品管理法。药品经营企业无须从具有药品生产、经营资格的企业购进的药品是未实施批准文号管理的中药材（A对）。《中华人民共和国药品管理法实施条例》第九条规定：药品生产企业生产药品所使用的原料药，必须具有国务院药品监督管理部门核发的药品批准文号或者进口药品注册证书、医药产品注册证书；但是，未实施批准文号管理的中药材、中药饮片除外。